腹部叩诊出现移动性浊音，游离液体量至少是
A. 100ml
B. 150ml
C. 500ml
D. 1000ml
E. 3000ml

正确答案：D。1000ml

解析：腹腔内有较多的液体存留时，因重力作用，液体多潴积于腹腔的低处，故在此处叩诊呈浊音。一般腹部叩诊出现移动性浊音，游离液体量至少是1000ml（D对）。